涎石病临床表现说法错误的是
A. 导管口黏膜红肿
B. 进食时，无任何症状
C. 少许脓性分泌物自导管口溢出
D. 双手触诊常可触及硬块，并有压痛
E. 小的涎石一般不造成唾液腺导管阻塞

正确答案：B。进食时，无任何症状

解析：涎石病患者进食时，腺体肿大、疼痛。掌握“涎石病及下颌下腺炎”知识点。